医师书写处方时经常使用外文缩写，医师在指导用药时需要准确掌握和解释，OD.是
A. 右眼
B. 左眼
C. 适量
D. 立即
E. 双眼

正确答案：A。右眼

解析：本题考查处方中常见的外文缩写及其含义。医师在书写处方正文时会采用拉丁文缩写或者英文缩写表示，其中右眼（A对）的英文缩写是OD.。左眼（B错）的英文缩写是OS.。双眼（E错）的英文缩写是OU.。适量（C错）的英文缩写是qs.。立即（D错）的英文缩写是St.。